具有激动/拮抗双重作用的镇痛药物是
A. 吗啡
B. 盐酸哌替啶
C. 盐酸曲马多
D. 盐酸美沙酮
E. 酒石酸布托啡诺

正确答案：E。酒石酸布托啡诺

解析：本题考查镇痛药物的作用特点。酒石酸布托啡诺（E对）可激动κ-阿片肽受体，对μ-受体则具激动和拮抗双重作用。